女孩，2岁。身材矮小，语言、运动发育后，平素纳差，便秘。查体：T36℃，P80次/分，神志清楚，反应淡漠，眼睑水肿，眼距宽，鼻梁低平，舌大而厚，皮肤粗糙，腹膨隆，未触及包块，四肢短小。心脏超声示心包积液。最可能诊断的疾病是
A. 21－三体综合征
B. 18－三体综合征
C. 先天性甲状腺功能减低症
D. 苯丙酮尿症
E. 黏多糖病

正确答案：C。先天性甲状腺功能减低症

解析：婴幼儿，身材矮小，语言、运动发育后，平素纳差，便秘，查体：T36℃，P80次/分，神志清楚，反应淡漠，眼睑水肿，眼距宽，鼻梁低平，舌大而厚，皮肤粗糙，腹膨隆，未触及包块，四肢短小（先天性甲低的典型体征），心脏超声示心包积液。最可能诊断的疾病是先天性甲状腺功能减低症（C对）。21－三体综合征（A错）患儿智能及动作发育落后，但有特殊面容：眼距宽、外眼眦上斜、鼻梁低、舌伸出口外，皮肤及毛发正常，无黏液性水肿，且常伴有其他先天畸形。苯丙酮尿症（D错）主要表现为智力落后、头发由黑变黄，皮肤白暂，有明显鼠尿臭味。黏多糖病（E错）共同特征是在出生1年后出现生长落后，主要表现为矮小，面容较丑陋、头大、鼻梁低平、鼻孔大、唇厚、前额和双颤突出、毛发多而发际低、颈短等。